药学咨询服务是执业药师应用所学专业知识面向患者、医护人员、公众等提供直接的、负责任的、与药品使用有关的服务，以期增强患者用药的依从性，减少药物不良反应，提高药物治疗的安全性、有效性与经济性。执业药师在用药咨询过程中的沟通技巧包括
A. 认真倾听
B. 注意语言表达
C. 注意非语言的运用
D. 咨询时间宜长不宜短
E. 提供的信息不宜过多

正确答案：A、B、C、E。认真倾听；注意语言表达；注意非语言的运用；提供的信息不宜过多

解析：本题考查的是药师的沟通技巧。执业药师在用药咨询过程中的沟通技巧包括认真倾听（A对）、注意语言表达（B对）、注意非语言的运用（C对）与提供的信息不宜过多（E对）。执业药师的沟通技巧沟通技巧：1.认真聆听：药师要仔细听取揣摩患者表述信息的内容和意思，不要轻易打断对方的讲话，以免影响表述者的思路和内容的连贯性。2.注意口头语言的表达：与患者沟通时注意多使用服务用语和通俗易懂的语言，尽量避免使用难懂的专业术语，尽量使用短句子，以助于患者对问题的理解和领会。3.注意肢体语言的运用：肢体语言作为沟通技巧的一种，能够表达我们的态度和情感，传递更加丰富的信息。4.注意书面语言的运用：书面语言的优势是准确、详尽、易于保存并可反复阅读。5.注意掌握时间：与患者的谈话时间不宜过长（D错），提供的信息也不宜过多，过多的信息不利于患者的掌握，反而会成为沟通的障碍。6.关注特殊人群：对特殊用药人群，如婴幼儿、老年人、少数民族和国外来宾等，需要特别详细提示服用药品的方法。